男性，34岁，突然寒战高热，咳嗽，两周后咳大量脓臭痰。查体：右肺背侧肩胛下部可闻湿性啰音，WBC21×10⁹/L，中性粒细胞0.88。此病人X线胸片可能出现的变化是
A. 右肺下叶背段均匀一致的片状阴影
B. 右肺下叶背段大片状阴影内可见有液平面空洞
C. 片状阴影内有厚壁空洞，内壁凹凸不平
D. 空洞形成，同侧或对侧有小片状条索状阴影
E. 两肺纹理增强呈卷发状阴影

正确答案：B。右肺下叶背段大片状阴影内可见有液平面空洞

解析：青年患者高热、咳嗽咳痰两周后咳大量脓臭痰，感染中毒症状重，且右肺背侧肩胛下部可闻湿性啰音，考虑为肺脓肿，符合肺脓肿的胸片为右肺下叶背段大片状阴影内可见有液平面空洞（B对）。